腮腺手术中寻找面神经颊支的标志是
A. 耳屏前
B. 腮腺导管
C. 腮腺上缘
D. 腮腺前缘
E. 腮腺上前缘

正确答案：B。腮腺导管

解析：本题考查面神经-颊支。腮腺手术中寻找面神经颊支的标志是腮腺导管（B对）。颊支多为3～5支，由颈面干发出，或来自颞面颈面两干。出腮腺前缘，行于咬肌筋膜的表面，据其与腮腺管的关系，可分位于其上方的上颊支及位于其下方的下颊支，两者分别走行于腮腺管上、下方各10mm的范围内。上颊支较粗，位置较恒定，其体表投影约在耳屏前切迹与鼻翼下缘的连线上，平行于腮腺管之上方。下颊支位置不恒定，在口角平面或其稍上方前行。颊支与腮腺管关系密切，在行腮腺切除手术时，可以腮腺管为标志，寻找并解剖面神经颊支。